LeFortⅡ型骨折是指
A. 颧弓上骨折
B. 锥形骨折
C. 水平骨折
D. 纵形骨折
E. 矢状骨折

正确答案：B。锥形骨折

解析：LeFortⅡ型骨折：又称上颌骨中位骨折或锥形骨折。骨折线自鼻额缝向两侧横过鼻梁、内侧壁、眶底、颧上颌缝，再沿上颌骨侧壁至翼突。有时可波及筛窦达颅前凹，出现脑脊液鼻漏。掌握“牙槽突骨折、颌骨骨折”知识点。